五味子中含有的主要化学成分为
A. 蒽醌
B. 木脂素
C. 黄酮
D. 萘醌
E. 苯醌

正确答案：B。木脂素

解析：本题考查的是五味子的主要化学成分。五味子中含有的主要化学成分为木脂素（B对）。五味子中含木脂素较多，约为5%。《中国药典》采用高效液相色谱法测定药材中五味子醇甲的含量，要求不得少于0.40%。蒽醌类（A错）类成分包括蒽酮及其不同还原程度的产物。含蒽醌类化合物的常用中药有大黄、虎杖、何首乌、芦荟、决明子等。黄酮（C错）类化合物广泛存在于自然界中，多存在于高等植物及羊齿类植物中。苔类中含有的黄酮类化合物为数不多，而藻类、霉菌、细菌中没有发现黄酮类化合物。含黄酮类化合物的常用中药有黄芩、葛根、银杏叶、槐花、陈皮、满山红等。许多萘醌（D错）类化合物具有明显的生物活性。含萘醌类化合物的常用中成药有紫草等。苯醌（E错）类化合物从结构上可分为邻苯醌和对苯醌两大类。从中药软紫草中分得的一些物质属于对苯醌类化合物。